七情致病直接伤及内脏常见于
A. 心脾肾
B. 心肝脾
C. 心肺脾
D. 心肾脾
E. 心肝肺

正确答案：B。心肝脾

解析：本题考查的是七情内伤致病的特点。七情致病直接伤及内脏常见于（B对）。七情，即喜、怒、忧、思、悲、恐、惊七种情志变化。七情异常是直接影响内脏功能，造成气机紊乱而发病的因素，故又称“内伤七情”，属于内伤病的一类致病因素。七情内伤致病的特点：（1）直接伤及内脏：不同的情志刺激可伤及不同的内脏，即怒伤肝、喜伤心、思伤脾、悲忧伤肺、惊恐伤肾。此外，心为五脏六腑之大主，又主神明，所以各种情志刺激都与心有关，心神受损又可涉及其他脏腑。情志所伤，又以心、肝、脾为多见。（2）影响内脏气机：情志所伤，主要影响脏腑气机，使其紊乱。主要的病变变化是：“怒则气上”“喜则气缓”“悲则气消”“恐则气下”“惊则气乱”“思则气结”。